下列属于《母婴保健法》规定可以申请医学技术鉴定的是
A. 对孕妇、产妇、保健服务有异议的
B. 对婚前医学检查结果有异议的
C. 对婚前卫生咨询有异议的
D. 对孕产期保健服务有异议的
E. 对医学指导意见有异议的

正确答案：B。对婚前医学检查结果有异议的

解析：《母婴保健法》规定，接受婚前医学检查人员对婚前医学检查结果有异议的（B对），可以申请医学技术鉴定，取得医学鉴定证明。